胎盘早期剥离、宫内死胎等产科并发症易发生DIC的主要原因是：
A. 凝血因子Ⅻ的激活
B. 血小板因子3(PF2)的释放
C. 红细胞素的释放
D. 大量组织因子（凝血因子Ⅲ)入血
E. 以上都不是

正确答案：D。大量组织因子（凝血因子Ⅲ)入血

解析：大量组织因子（凝血因子Ⅲ)入血（D对），激活外源性凝血系统，启动凝血过程是胎盘早期剥离、宫内死胎等产科意外易发生DIC的主要原因。凝血因子Ⅻ的激活（A错）是内源性凝血系统的激活。血小板因子3 (PF2)的释放（B错），血小板与胶原组织接触发生黏附、聚积，血小板破裂，释放出PF，从而参与凝血和止血过程。红细胞素的释放（C错）是红细胞大量破坏，破坏的 红细胞释放大量 ADP等促凝物质，促进血小板黏附、聚集，导致凝血。